下列含碘酪氨酸衍生物中哪种生物活性最强
A. T₄
B. γT₃
C. T₃
D. MIT
E. DIT

正确答案：C。T₃